对乙类传染病和突发原因不明的传染病需要采取甲类传染病的预防、控制措施的，由下列哪一机构予以公布、实施
A. 国务院
B. 国家卫生行政部门
C. 省级卫生行政部门
D. 市级卫生行政部门
E. 县级卫生行政部门

正确答案：B。国家卫生行政部门